目前已知的最剧烈的毒素是
A. 白喉毒素
B. 沙门氏菌的肠毒素
C. 链球菌溶血素
D. 肉毒毒素
E. 结核菌素

正确答案：D。肉毒毒素

解析：肉毒毒素主要是神经外毒素，即肉毒毒素，为已知最剧烈的毒素。掌握“无芽胞厌氧菌”知识点。